我国现行的《环境空气质量标准》中，采用何种指标来规定PM₂.₅的限值
A. 8小时平均浓度限值和年平均浓度限值
B. 日平均浓度限值和月平均浓度限值
C. 日平均浓度限值和年平均浓度限值
D. 1小时平均浓度限值和年平均浓度限值
E. 日平均浓度限值和季平均浓度限值

正确答案：C。日平均浓度限值和年平均浓度限值

解析：本题考查环境空气质量标准的相关内容。我国现行的《环境空气质量标准》中，采用日平均浓度限值和年平均浓度限值（C对ABDE错）来规定PM₂.₅的限值。日平均浓度是指一个自然日24小时平均浓度的算术平均值其限值是指任何一个自然日24小时平均浓度的最高容许值。年平均浓度是指一个日历年内各日平均浓度的算术平均值，其限值是指任何一个日历年内各日平均浓度的算术均值的最高容许值。